下列属于苯烷胺类选择性钙拮抗药是
A. 硝苯地平
B. 维拉帕米
C. 普尼拉明
D. 哌克昔林
E. 氟桂利嗪

正确答案：B。维拉帕米

解析：目前应用于临床的钙通道阻滞剂主要是选择性作用于电压依赖性钙通道L亚型的药物，根据其化学结构特点，分为3个亚类：二氢吡啶类如硝苯地平（A错）、尼卡地平等；苯并噻氮䓬类如地尔硫䓬等；苯烷胺类如维拉帕米（B对）等。普尼拉明、哌克昔林、氟桂利嗪是非选择性钙通道阻滞剂（CDE错）。